既能泻下逐水，又能去积杀虫的药物是
A. 榧子
B. 甘遂
C. 使君子
D. 牵牛子
E. 京大戟

正确答案：D。牵牛子

解析：牵牛子的功效是泻水通便，杀虫攻积，消痰涤饮（D对）。榧子（A错）的功效是杀虫消积，润肺止咳，润燥通便。甘遂（B错）的功效是泻水逐饮，消肿散结。使君子（C错）的功效是杀虫消积。京大戟（E错）的功效是泻水逐饮，消肿散结。